某县药品监督管理部门对当地一家药品零售企业（经营范围：化学药、生物制品、中成药、中药饮片）进行日常检查的过程中，发现其人员包括：法定代表人甲：具备执业药师资格（药学），2015年开办该药品零售企业，注册的执业单位为该药品零售企业。执业药师（中药学）乙：具备执业药师资格（中药学），注册在该药品零售企业。店员丙：某大专院校药学专业毕业后一直在该药品零售企业工作。检查当日上午，甲与乙外出参加继续教育，丙在岗。检查期间，有消费者丁到店，向丙表示欲购买罗红霉素片1盒（生产企业为国外某制药有限公司，2020年8月获批在中国上市），甲类非处方药通便灵胶囊1盒，但因时间匆忙，没来得及前往医院就诊开具处方。关于甲执业行为的说法，错误的是
A. 甲对该药品零售企业的经营活动全面负责，应当熟悉药品经营监管的法律法规
B. 为提升药学服务效率，甲通过网络审核其执业单位药品处方，不再到店执业
C. 甲的执业药师注册证应当在营业场所的显著位置挂牌明示
D. 甲负责该药品零售企业的药品管理、处方审核和调配、合理用药指导等工作

正确答案：B。为提升药学服务效率，甲通过网络审核其执业单位药品处方，不再到店执业

解析：本题考查药品零售的经营行为管理的经营行为管理禁止类行为。关于甲执业行为的说法，错误的是为提升药学服务效率，甲通过网络审核其执业单位药品处方，不再到店执业（B错，为本题正确答案）。药品零售连锁企业总部的经营行为管理禁止类行为：不得以“远程审方”等方式替代国家对执业药师的配备要求。药品上市许可持有人、药品经营企业法定代表人和主要负责人对药品经营活动全面负责，并应当熟悉药品经营监管的法律法规（A对）。药品零售企业应当在醒目位置公示《执业药师注册证》，并对在岗执业的执业药师挂牌明示（C对）。执业药师不在岗时，应当以醒目方式公示，并停止销售处方药和甲类非处方药。执业药师依法负责药品管理、处方审核和调配、合理用药指导等工作（D对）。